出现呼吸音增强的疾病是
A. 重症肌无力
B. 贫血
C. 胸膜炎
D. 膈肌瘫痪
E. 急性弥漫性腹膜炎

正确答案：B。贫血

解析：出现呼吸音增强的疾病是（B对）。重症肌无力（A错）、膈肌瘫痪（D错）会导致肺泡呼吸音减弱或消失（八版诊断学P137）。胸膜炎（C错）会导致呼吸音减弱。急性弥漫性腹膜炎（E错）时呼吸浅快，听诊肠鸣音减弱或消失。